手-足-口病前驱发病部位不包括
A. 颊
B. 手掌
C. 足底
D. 肛门
E. 唇

正确答案：D。肛门

解析：手-足-口病：前驱症状有发热、困倦与局部淋巴结肿大，然后在口腔黏膜、手掌、足底出现散在水疱、丘疹与斑疹，数量不等。口腔损害广泛分布于唇、颊、舌、腭等处。掌握“手-足-口病”知识点。